下列属于成碱性食物的是
A. 蔬菜
B. 米饭
C. 面粉
D. 肉类
E. 食盐

正确答案：A。蔬菜

解析：碱性食物大多数含有钾钙的比较多，主要是以水果蔬菜为主。日常生活中碱性食物有番茄，西葫芦，萝卜，茄子，莴苣，苦瓜，油菜，菠菜，蘑菇，菜花，金针菇，芒果，石榴，香蕉，山楂，葡萄，龙眼等。人体的酸碱平衡是能够自身调节的，会固定在一定的范围之内，酸碱性食物都含有膳食纤维，能够很好的促进肠道的消化和吸收，加速新陈代谢，使身体更易吸收营养，还能够使得血液中乳酸、尿素等酸性物质减少，防止其在管壁上沉积，因此有软化血管、预防心脑血管疾病的作用。